基底动脉的分支不出现
A. 大脑后动脉
B. 大脑中动脉
C. 小脑上动脉
D. 迷路动脉
E. 小脑下前动脉

正确答案：B。大脑中动脉

解析：左、右椎动脉汇合成一条基底动脉，基底动脉又分成小脑下前动脉（E对）、迷路动脉（D对）、脑桥动脉、小脑上动脉（C对）、大脑后动脉（A对）5个主要分支（B错，为本题正确答案）。